花生油被黄曲霉毒素污染，去毒的首选措施为
A. 兑入其他油
B. 白陶土吸附
C. 加碱去毒
D. 紫外线照射
E. 氨气处理

正确答案：C。加碱去毒

解析：本题考查花生油被黄曲霉毒素污染，去毒的首选措施。花生油被黄曲霉毒素污染，去毒的首选措施为加碱去毒法（C对ABDE错）。黄曲霉毒素与NaOH反应，其结构中的内酯环被破坏形成香豆素钠盐，后者溶于水，故加碱后再用水洗可去除毒素。